具燥湿健脾、祛风湿功效的药物是
A. 苍术
B. 独活
C. 厚朴
D. 薏苡仁
E. 广藿香

正确答案：A。苍术

解析：本题考查的是苍术的功效。具燥湿健脾、祛风湿功效的药物是苍术（A对）。苍术：【功效】燥湿健脾，祛风湿，发汗，明目。独活（B错）：【功效】祛风湿，止痛，解表。厚朴（C错）：【功效】燥湿，行气，消积，平喘。薏苡仁（D错）：【功效】利水渗湿，健脾止泻，除痹，清热排脓。广藿香（E错）：【功效】化湿，止呕，发表解暑。